下列各项，不属产后尿潴留气虚证主要症状的是
A. 产后小便不通
B. 小腹胀急疼痛
C. 气短懒言
D. 面色晦暗
E. 舌淡，苔薄白，脉缓弱

正确答案：D。面色晦暗

解析：产后由于体质虚弱或产时失血耗气，或新产忧思劳累过度，肺脾之气亦虚，无力通调水道，转输水液，水液停滞脬中，膀胱气化不利，故小便不通（A对），小腹胀急疼痛或小便清白，点滴而下（B对）；气虚中阳不振，故倦怠乏力，少气懒言，语音低微（C对）；产后气虚血亦亏，不能上荣于面，则面色少华（D错，为本题正确答案）；舌淡，苔薄白，脉缓弱（E对），皆为气血亏虚之征。